黄疸形成的关键病理因素是
A. 热邪
B. 寒邪
C. 疫毒
D. 瘀血
E. 湿邪

正确答案：E。湿邪

解析：黄疸的基本病机为湿邪壅阻中焦，脾胃失健，肝气郁滞，疏泄不利，致胆汁疏泄失常，胆液不循常道，外溢肌肤，下注膀胱，而发为目黄、肤黄、小便黄的病证。黄疸的病位主要在脾、胃、肝、胆。其病理因素有湿邪、热邪、寒邪、疫毒、气滞、血瘀六种，但其中以湿邪为主。湿邪既可从外感而受，亦可以从内而生，如外感湿热疫毒，为湿从外受；饮食劳倦或病后瘀阻湿滞，属湿自内生，为最主要的病理因素（E对）（ABCD错）。